毒性中药的药性峻烈，掌握其用法用量显得尤为重要。用量0.015g～0.03g，多入丸散用的毒性中药是
A. 生附子
B. 蟾酥
C. 生甘遂
D. 红粉
E. 天仙子

正确答案：B。蟾酥

解析：本题考查的是部分毒性中药品种的用法用量。用量0.015g～0.03g，多入丸散用的毒性中药是蟾酥（B对）。蟾酥的用法用量：0.015～0.03g，多入丸散用。外用适量。注意事项：孕妇慎用。生附子（A错）的用法用量：用量3～15g。先煎，久煎。注意事项：孕妇慎用；不易与半夏、瓜蒌、瓜蒌子、瓜蒌皮、天花粉、川贝母、浙贝母、平贝母、伊贝母、湖北贝母、白蔹、白及同用。孕妇慎用。生甘遂（C错）的用法用量：内服，0.5～1.5g，炮制后多入丸散用。外用适量，生用。注意事项：孕妇禁用，不宜与甘草同用。红粉（D错）的用法用量：外用适量，研极细粉单用或与其他药味配伍成散剂或制成药捻。注意事项：只可外用，不可内服。外用亦不宜久用；孕妇禁用。生天仙子（E错）的用法用量：内服，0.06～0.6g。注意事项：心脏病、心动过速、青光眼患者及孕妇禁用。